以下哪项不是社会医学研究的特点
A. 研究内容的单一性
B. 研究因素的复杂性
C. 研究具有实践性
D. 研究具有时代性

正确答案：A。研究内容的单一性

解析：本题考查社会医学研究的特点。社会医学研究的特点有：研究内容的广泛性（A错，为本题正确答案）；研究因素的复杂性（B对）；研究具有实践性（C对）；研究具有时代性（D对）。